下列哪项不是评价诊断试验的指标
A. 符合率
B. 相对危险度
C. 预测值
D. 似然比
E. Kappa值

正确答案：B。相对危险度

解析：本题考查评价诊断试验的指标。符合率（A对）、预测值（C对）、似然比（D对）和Kappa值（E对）都是评价诊断试验的指标。相对危险度（B错，为本题正确答案）不是评价诊断试验的指标。